服用非处方药溴丙胺太林常见的不良反应为
A. 恶心、呕吐、腹泻
B. 尿频、尿急、血尿
C. 锥体外系反应
D. 妇女乳房胀痛
E. 口干、视力模糊

正确答案：E。口干、视力模糊

解析：本题考查溴丙胺肽林的不良反应。溴丙胺太林为M胆碱受体阻断剂，可抑制腺体分泌，松弛平滑肌。常见的不良反应为有视物模糊（E对），口鼻咽喉干燥、便秘、出汗减少、瞳孔散大、眼睑炎、眼压升高、排尿困难等。